关于管周牙本质的说法，下列错误的一项是
A. 又被称为管内牙本质
B. 基质是由成牙本质细胞合成
C. 由成牙本质细胞释放于小管内侧
D. 含有较多的糖胺聚糖
E. 矿化程度较低

正确答案：E。矿化程度较低

解析：管周牙本质矿化程度较高，其生成于已存在的小管内侧。其基质由成牙本质细胞合成，由其细胞骨架运送到突起并释放于小管的内侧，故称之为管内牙本质。含有较多的糖胺聚糖。掌握“牙本质”知识点。